药品的内包装
A. 必须按照规定印有或贴有标签并附有说明书
B. 分为大包装和中包装
C. 必须印有商标
D. 指直接与药品接触的包装
E. 必须注明不良反应

正确答案：D。指直接与药品接触的包装